下列疾病中，最常出现Ⅱ型呼吸衰竭的是
A. 肺结核
B. 矽肺
C. 膈肌瘫痪
D. 特发性肺纤维化
E. 肺水肿

正确答案：C。膈肌瘫痪

解析：Ⅱ型呼吸衰竭即高碳酸性呼吸衰竭，多为肺泡通气不足所致，单侧膈肌瘫痪者肺活量可减低37%，通气量减低20%，故膈肌瘫痪常出现Ⅱ型呼吸衰竭（C对）。Ⅰ型呼吸衰竭即低氧性呼吸衰竭主要机制为气道阻塞、肺组织和肺血管病变造成的呼吸衰竭称为肺衰竭，肺实质和肺血管病变常引起换气功能障碍，表现为Ⅰ型呼吸衰竭。如严重肺部感染性疾病（A错）、间质性肺疾病（特发性肺纤维化等）（D错）、急性肺栓塞、急性肺水肿（E错）等。矽肺（B错）又称硅肺，是由于长期吸入大量游离二氧化硅粉尘所引起，肺部广泛的结节性纤维化、肺顺应性减退，可出现限制性通气功能障碍，故矽肺可引起Ⅰ型呼吸衰竭。